初孕妇，28岁。妊娠37+4周，剧烈头痛并呕吐3次。查体：BP170/110mmHg，尿蛋白（++），双下肢轻度水肿。无宫缩，枕右前位，胎心率138次/分，估计胎儿体重2800g。该患者应立即采取的处理措施是
A. 静脉滴注缩宫素
B. 人工破膜后静滴缩宫素
C. 静滴硫酸镁及快速静滴甘露醇
D. 立即行剖宫术
E. 肌注哌替啶

正确答案：C。静滴硫酸镁及快速静滴甘露醇

解析：该初孕妇，妊娠37+4周，剧烈头痛并呕吐（重度子痫前期可有持续头痛、呕吐或视觉障碍或其它脑神经症状，提示颅内高压），BP170/110mmHg（重度子痫前期收缩压≥160mmHg和（或）舒张压≥110mmHg）），尿蛋白（++），双下肢轻度水肿，考虑诊断为重度子痫前期。无宫缩，枕右前位，胎心率138次/分（正常胎心音110～160次/分），估计胎儿体重2800g，提示胎儿状况良好。妊娠37周后的重度子痫前期应终止妊娠，但该患者颅内高压，应立即采取的处理措施是静滴硫酸镁及快速静滴甘露醇（C对），预防子痫发作、降低颅内压，之后再终止妊娠（D错）。终止妊娠时，如无产科剖宫产指征，原则上考虑阴道试产。但如果不能短时间内阴道分娩，病情有可能加重，可考虑放宽剖宫产指征（AB错）。肌注哌替啶（P70）（B错）为子痫发作时的解痉降压药，因会使血压急剧下降，导致肾及子宫胎盘血供减少，导致胎儿缺氧，仅用于硫酸镁治疗效果不佳者。